下列化合物的IR光谱中出现三个羰基吸收峰的是
A. 大黄素
B. 大黄酸
C. 大黄素甲醚
D. 芦荟大黄素
E. 大黄酚

正确答案：B。大黄酸